下列哪一项不属于化脓性颌骨骨髓炎的分型
A. 慢性根尖周脓肿
B. 急性边缘性颌骨骨髓炎
C. 慢性中央性颌骨骨髓炎
D. 溶解型边缘性颌骨骨髓炎
E. 增生型边缘性颌骨骨髓炎

正确答案：A。慢性根尖周脓肿

解析：根尖脓肿属于根尖周炎症，不属于颌骨骨髓炎分型。掌握“颌骨骨髓炎”知识点。